RNA聚合酶Ⅱ（TFⅡ）中能与TATA盒直接结合的是
A. TFⅡA
B. TFⅡB
C. TFⅡD
D. TFⅡE
E. TFⅡF

正确答案：C。TFⅡD